关于白蛋白结合型紫杉醇的特点说法正确的是
A. 推荐30分钟内完成静脉滴注
B. 过敏反应发生率极低，无需预处理
C. 无需使用非聚氯乙烯材质输液器
D. 用0.9%的氯化钠注射液作为溶剂
E. 与紫杉醇注射液相比，不良反应发生率高

正确答案：A、B、C、D。推荐30分钟内完成静脉滴注；过敏反应发生率极低，无需预处理；无需使用非聚氯乙烯材质输液器；用0.9%的氯化钠注射液作为溶剂

解析：本题考查白蛋白结合型紫杉醇的特点。白蛋白结合型紫杉醇注射时无需使用非聚氯乙烯材质输液器（C对），用0.9%的氯化钠注射液作为溶剂（D对），推荐30分钟内完成静脉滴注（A对）。其过敏反应发生率极低，无需预处理（B对）。